脑出血最常见的原因是
A. 脑动脉炎
B. 高血压和脑动脉硬化
C. 血液病
D. 脑动脉瘤
E. 脑血管畸形

正确答案：B。高血压和脑动脉硬化